按氟斑牙的Dean分度标准，若釉质表面失去光泽，可见明显的白垩样改变，但不超过牙面的50%，应判定氟斑牙
A. 可疑
B. 很轻
C. 轻度
D. 中度
E. 重度

正确答案：C。轻度

解析：本题考查氟斑牙的Dean分度标准。按氟斑牙的Dean分度标准，若釉质表面失去光泽，可见明显的白垩样改变，但不超过牙面的50%，应判定为轻度（C对ABDE错）氟斑牙。